1990年8月，某远洋客轮上发生一起军团病爆发流行。船离开港口时载有350名乘客、50名船员。8月1日前的一周内，在一次风暴中有七分之一的乘客遇难。8月份第一周中，船上有30人发生军团病，其中一半很快死亡。随后的一周内又有20人发病，但无死亡。假设症状持续一个月。8月7日（8月份第一周的最后一天）军团病的患病率是
A. 0.045
B. 0.075
C. 0.143
D. 用该资料不能计算
E. 以上答案均不是

正确答案：A。0.045

解析：本题考查患病率的计算。患病率＝（某一时点某人群中某病新旧病例数/该时点人口数）＝（30－15）/（350+50-350×1/7-30×1/2）＝0.045（A对BCDE错）。